能补肾壮阳、祛风除湿的药是
A. 海马
B. 鹿茸
C. 淫羊藿
D. 补骨脂
E. 肉苁蓉

正确答案：C。淫羊藿

解析：本题考查淫羊藿的功效。能补肾壮阳、祛风除湿的药是淫羊藿（C对）。淫羊藿【功效】补肾阳，强筋骨，祛风湿。海马（A错）【功效】补肾助阳，活血散结，消肿止痛。鹿茸（B错）【功效】壮肾阳，益精血，强筋骨，调冲任，托疮毒。补骨脂（D错）【功效】补肾壮阳，固精缩尿，温脾止泻，纳气平喘。肉苁蓉（E错）【功效】补肾阳，益精血，润肠通便。